邻面板与天然牙间形成的力为
A. 摩擦力
B. 吸附力
C. 表面张力
D. 大气压力
E. 重力

正确答案：A。摩擦力

解析：摩擦力：义齿部件（主要指卡环等固位体及部分基托、邻面板）与天然牙间形成的力。掌握“局部义齿人工牙及基托”知识点。